男孩，5岁，因体格和智力发育落后来诊。查体：身材矮小，眼距宽，鼻梁低，外耳小，头围小，骨龄落后于年龄，通贯手，胸骨左缘第3-4间可闻及3/6级收缩期杂音，确诊要做的检查是
A. 染色体核型分析
B. 尿有机酸测定
C. 头颅CT
D. 超声心动图
E. 血清T3、T4、TSH检测

正确答案：A。染色体核型分析

解析：患儿因体格和智力发育（唐氏患儿最突出及严重表现）落后来诊。查体：身材矮小，眼距宽，鼻梁低，外耳小，头围小（特殊面容），骨龄落后于年龄（体格发育迟缓），通贯手（特有皮纹），胸骨左缘第3-4间可闻及3/6级收缩期杂音（室间隔缺损），考虑诊断为1.唐氏综合征；2.室间隔缺损。根据题意，选择查染色体核型分析（A对）以确诊唐氏综合征。